某患者曾有坏死性口炎病史，现开口受限，在上颌结节与下颌升支之间可触及条索状区域，X线片显示颞下颌关节结构正常，最可能的诊断是
A. 癔病性牙关紧闭
B. 咀嚼肌痉挛
C. 颌间瘢痕挛缩
D. 关节内强直
E. 破伤风牙关紧闭

正确答案：C。颌间瘢痕挛缩

解析：关节外强直也称颌间瘢痕挛缩，常见病因过去以坏疽性口炎（形成瘢痕组织）最多。目前，常见病因是损伤、口腔内手术创面处理不当、鼻咽部以及颞下窝肿物放疗后等造成的关节外瘢痕。掌握“颞下颌关节强直”知识点。